患者，男，65岁。眩晕，耳鸣如蝉，健忘失眠，胁痛，腰膝酸痛，盗汗，舌红少苔，脉细数。其证候是
A. 肾精不足
B. 肾阴虚
C. 肝阴虚
D. 肝肾阴虚
E. 肝阳上亢

正确答案：D。肝肾阴虚

解析：肝肾阴虚证以腰酸胁痛、眩晕、耳鸣、遗精等与虚热症状共见为辨证的主要依据。患者肝肾阴虚，肝络失滋，经气不利，则胁部隐痛；水不涵木，肝阳上扰，则眩晕；肝肾阴虚，不能上养清窍，濡养腰膝，则耳鸣，健忘，腰膝酸痛；虚热内炽，则盗汗，舌红少苔，脉细数。故患者所患证型为肝肾阴虚证（D对）。肾精不足证指肾精亏虚，脑与骨、髓失充，以生长发育迟缓、早衰、生育机能低下等为辨证的主要依据。此证无阴虚内热的表现（A错）。肾阴虚证以腰膝酸软、遗精、经少、头晕耳鸣等与阴虚症状共见为辨证的主要依据。患者出现胁痛是由肝络失滋引起的，与肾阴虚无关（B错）。肝阴虚证以头晕、目涩、胁痛等与虚热症状共见为辨证的主要依据。患者出现腰膝酸软是肾阴虚的症状，而非肝阴虚的症状（C错）。肝阳上亢指肝阳亢于上，肝肾阴亏与下，以眩晕耳鸣、头目胀痛、面红、烦躁、腰膝酸软等为辨证的依据。此证由于肝阳亢盛，故脉弦有力或弦细数，并且有热象，而患者脉细数且热象症状不明显（E错）。